欲了解某地小学生近视眼情况，应采用
A. 个例调查
B. 前瞻性调查
C. 抽样调查
D. 普查
E. 回顾性调查

正确答案：C。抽样调查

解析：本题考查抽样调查的用途。抽样调查（C对ABDE错）是通过对样本中的研究对象的调查研究来推论其所在总体的情况的一种研究方法。欲了解某地小学生近视眼情况，应采取现况研究的研究方法。由于小学生人数众多，采取普查费时费力，且工作不容易做细致，因此采用抽样调查的方法，用样本来估计总体所在的情况。